患者，男，30岁，高温职业工人。现见神情淡漠，身热汗出，口干喜饮，四肢厥冷，唇甲紫绀，体疲乏力，小便短赤，大便秘结，舌红苔黄少津，脉细数。查体：血压75/50mmHg（10/6.6kPa）。治疗应首选
A. 参附注射液加枳实注射液
B. 丹参注射液加参附注射液
C. 醒脑静注射液加丹参注射液
D. 生脉注射液加清开灵注射液
E. 枳实注射液加丹参注射液

正确答案：D。生脉注射液加清开灵注射液

解析：患者高温作业后，耗气伤阴，不能固摄，故见身热汗出，口干喜饮；气虚阳伤，故见四肢厥冷，唇甲紫绀，体疲乏力；阴虚不能濡养，故见小便短赤，大便秘结；舌红苔黄少津，脉细数，均为气阴两虚证表现。治疗需益气养阴，开窍醒神。代表方为生脉注射液加清开灵注射液（D对）。参附注射液加枳实注射液（A错）可以益气温阳，滋阴养液。丹参注射液加参附注射液（B错）可滋阴温阳。醒脑静注射液加丹参注射液（C错）可开窍醒神，滋补阴液。枳实注射液加丹参注射液（E错）可破气消积，滋阴养液。